女，69岁，呼吸困难伴左胸痛2天。活动后呼吸困难加重，胸痛于吸气时加重，无咳嗽、咳痰、咯血和发热。结肠癌术后化疗中。查体：BP110/75mmHg，口唇发绀，左下肺可闻及少许细湿啰音，心率96次/分，律齐，P₂＞A₂，胸骨左缘第5肋间可闻及2/6级收缩期杂音。首先考虑的诊断是
A. 重症肺炎
B. 急性左心衰竭
C. 肺血栓栓塞
D. 急性心肌梗死
E. 结肠癌肺转移

正确答案：C。肺血栓栓塞

解析：患者为老年女性，现结肠癌术后化疗中（有肺血栓栓塞的继发性危险因素），活动后呼吸困难突然加重，伴有胸痛，P₂＞A₂（提示肺动脉高压），胸骨左缘第5肋间可闻及2/6级收缩期杂音，根据其临床表现和辅助检查，可考虑诊断为肺血栓栓塞（C对）（患者有肺血栓栓塞症的继发性危险因素和典型临床表现、体征和辅助检查）。重症肺炎（A错）是指需要有创机械通气并发感染性休克的肺炎，该患者无咳嗽、咳痰、咯血和发热，故不考虑重症肺炎。急性左心衰竭（B错）（P174-P175）主要表现为突发严重呼吸困难，强迫坐位、面色发灰、发绀、大汗，同时频繁咳嗽，咳粉红色泡沫状痰，两肺布满湿性啰音和哮鸣音，与该患者表现不符，故不考虑。急性心肌梗死（D错）（P236）一般有心绞痛病史，主要表现为胸骨后濒死样疼痛等心肌缺血表现，心电图示心肌梗死的特征性与动态性改变，不符合患者的表现。结肠癌肺转移（E错）前期症状不明显，肺部病变广泛，则可出现干咳、痰血表现，随着病情的严重，患者如并发癌性淋巴管炎、大量胸腔积液、肺不张或上腔静脉受压时，患者可出现呼吸困难或者持续性的发热等现象。